随机抽取甲地15名9岁女童与乙地15名9岁女童体重（kg），其均数比较的检验为
A. 样本均数与总体均数比较的t检验
B. 配对t检验
C. 成组t检验
D. u检验
E. χ²检验

正确答案：C。成组t检验